关于固体分散体特点的说法，错误的是
A. 固体分散体可延缓药物的释放
B. 固体分散体可减小药物的刺激性
C. 固体分散体可使药物具有靶向性
D. 固体分散体可提高药物的稳定性
E. 固体分散体可提高药物的生物利用度

正确答案：C。固体分散体可使药物具有靶向性

解析：本题考查的是中药制剂新技术-固体分散体的特点。固体分散体不能使药物具有靶向性（C错，为本题正确答案）。固体分散体是指药物与载体混合制成的高度分散的固体分散物。制备成固体分散体的技术称为固体分散技术。固体分散技术将药物以分子、胶态、微晶或无定形状态分散在水溶性材料、难溶性或肠溶性材料中形成固体分散体。固体分散体具备如下特点：①达到不同的释药目的：利用亲水性高分子载体材料增加难溶性药物的溶解度和溶出度，提高药物的生物利用度（E对）；利用难溶性高分子载体材料延缓或控制药物释放（A对）；利用肠溶性高分子载体材料控制药物于小肠或结肠定位释放。②延缓药物的水解和氧化（D对）。③掩盖药物的不良气味和刺激性（B对）。④使液体药物固体化。药物具有靶向性是靶向制剂的作用。